糖原合成时形成活化的葡萄糖时消耗
A. ATP
B. CTP
C. GTP
D. UTP
E. TTP

正确答案：D。UTP